中和1g挥发油中游离酸性成分所需要的氢氧化钾的毫克数表示
A. 酸值
B. 碱值
C. 皂化值
D. 酯值
E. 极性

正确答案：A。酸值